关于乙状结肠的叙述，不正确的是
A. 在左髂嵴处续自降结肠
B. 沿左髂窝转入盆腔
C. 呈“乙”字形弯曲
D. 在第4腰椎平面续于直肠
E. 是肿瘤和憩室的多发部位

正确答案：D。在第4腰椎平面续于直肠

解析：乙状结肠在左髂嵴处续自降结肠(A对)，沿左髂窝转入盆腔内(B对)，呈“乙”字形弯曲(C对)，在第3骶椎平面续于直肠(D错，为本题正确答案)，是憩室和肿瘤的多发部位(E对)。